桑杏汤是治疗咳嗽的常用方剂，其针对的证候是
A. 风寒犯肺
B. 风热犯肺
C. 痰热壅肺
D. 燥邪伤肺
E. 肺肾阴虚

正确答案：D。燥邪伤肺

解析：本题考查的是咳嗽的辨证论治。桑杏汤是治疗咳嗽的常用方剂，其针对的证候是咳嗽燥邪伤肺（D对）。咳嗽是指肺失宣降，肺气上逆作声，或伴咳吐痰液，为肺系疾病的主要表现之一。（一）风寒袭肺（A错）证：【方剂应用】基础方剂为三拗汤（麻黄、杏仁、甘草）合止嗽散（桔梗、荆芥、甘草、白前、陈皮、百部、紫菀）加减。（二）风热犯肺（B错）证：【方剂应用】基础方剂为桑菊饮（桑叶、苦杏仁、芦根、菊花、甘草、连翘、薄荷、桔梗）加减。（三）风燥伤肺证：【方剂应用】基础方剂为桑杏汤（桑叶、苦杏仁、沙参、象贝、香豉、栀子、梨皮）加减。（四）痰湿蕴肺证：【方剂应用】基础方剂为二陈平胃散（陈皮、半夏、茯苓、甘草、苍术、厚朴）合三子养亲汤（紫苏子、白芥子、莱菔子）加减。（五）痰热郁肺（C错）证：【方剂应用】基础方剂为清金化痰汤（黄芩、栀子、桔梗、麦冬、桑白皮、贝母、知母、瓜蒌仁、橘红、茯苓、甘草）加减。（六）肺阴亏耗证：【方剂应用】基础方剂为沙参麦冬汤（沙参、玉竹、生甘草、冬桑叶、麦冬、生扁豆、天花粉）加减。病证肺肾阴虚（E错），2022年考试指南未明确说明。